莪术除破血行气外，又能
A. 凉血清心
B. 化瘀止血
C. 下乳消肿
D. 消积止痛
E. 消肿生肌

正确答案：D。消积止痛

解析：本题考查的是莪术的功效。莪术除破血行气外，又能消积止痛（D对）。莪术：【功效】破血行气，消积止痛。郁金：【功效】活血止痛，行气解郁，凉血清心（A错），利胆退黄。五灵脂：【功效】活血止痛，化瘀止血（B错），解蛇虫毒。王不留行：【功效】活血通经，下乳消肿（C错），利尿通淋。乳香：【功效】活血止痛，消肿生肌（E错）。